男70岁。因脑出血1小时入院，病情危重。医生建议立即手术，并告知家属手术可能存在的风险，不手术则会有生命危险。家属因经济困难，示意医生只需作简单处置，放弃救治，听任其死亡，但拒绝对此签字。此时医生应选择的最佳决策是
A. —定要家属签字，否则让病人转院
B. 听从家属决定，并在病历上如实记录家属意见
C. 征求医院领导意见并与家属充分沟通，确定符合实际的救治手段
D. 提请法院作出决策
E. 不考虑家属意见，医生直接手术

正确答案：C。征求医院领导意见并与家属充分沟通，确定符合实际的救治手段

解析：在此种情况下，与病人家属的沟通中，医生首先要确认手术的必要，对家属说明病人的情况，权衡手术的利弊。在病人及其家属知情的基础上征得同意，还需要让其签订同意麻醉和手术的书面协议（C对E错）。病人家属有选择治疗的自主权，不能逼迫其签字（A错）。听从家属决定，不符合无伤害的医德准则（B错）。紧急情况下，医生具有救治的自主权，提请由法院等待法院作出决议不合适（D错）。